气管颈段长度及气管软骨环的个数分别是
A. 4.5cm、3～5个
B. 4.5cm、6～8个
C. 6.5cm、3～5个
D. 6.5cm、6～8个
E. 8.5cm、3～5个

正确答案：D。6.5cm、6～8个

解析：气管颈段位于肌三角内，上接环状软骨，下平胸骨颈静脉切迹与气管胸段相延续，长约6.5cm，有6～8个气管软骨环。掌握“气管颈段、颈动脉三角的解剖特点及临床应用”知识点。